根据《传染病防治法》规定，需按照甲类传染病采取预防控制措施的乙类传染病是
A. 疟疾
B. 肺炭疽
C. 登革热
D. 梅毒
E. 肺结核

正确答案：B。肺炭疽

解析：根据《传染病防治法》规定，传染性非典型肺炎、炭疽中的肺炭疽（B对）和人感染高致病性禽流感等属于乙类传染病，但应按照甲类传染病采取预防控制措施。疟疾（A错）、登革热（C错）、梅毒（D错）、肺结核（E错）都是乙类传染病。